不是血管性痴呆和阿尔茨海默病的临床鉴别要点的是
A. 早期人格是否保持良好
B. 病程是否呈波动性
C. 痴呆的严重程度
D. Hachinski量表评分
E. 是否有高血压史

正确答案：C。痴呆的严重程度

解析：阿尔茨海默病（AD）是发生于老年和老年前期、以进行性认知功能障碍和行为损害为特征的中枢神经系统退行性病变，是老年痴呆的最常见类型。血管性痴呆（VD）包括缺血性或出血性脑血管病，或者是心脏和循环障碍引起的低血流灌注所致的各种临床痴呆。AD与VD的鉴别要点有：（1）性别：AD女性多见，VD男性多见；（2）病程：AD呈持续进行性发展，VD呈波动性（B对）进展；（3）自觉症状：AD自觉症状少，VD头痛、眩晕、肢体麻木等自觉症状常见；（4）认知功能：AD为全面性痴呆、人格崩溃，VD人格相对保留（A对）；（5）伴随症状：AD伴精神行为异常，VD伴局灶性神经系统症状体征；（6）CT/MRI检查：AD示脑萎缩，VD示有可与高血压病史（E对）相关的脑梗死、脑出血灶；（7）PET/SPECT检查：AD为颞、顶叶对称性血流低下，VD为局限性非对称性血流低下；（8）Hachinski缺血评分量表（D对）：AD评分≦4分；VD评分≥7分。痴呆的严重程度（C错，为本题正确答案）不能作为AD与VD的临床鉴别要点。